小儿化脓性脑膜炎和其他脑膜炎的鉴别主要依靠
A. 临床表现
B. 神经系统异常症状和体征
C. 脑脊液常规及细菌学检查结果
D. 血常规
E. 呼吸道感染症状

正确答案：C。脑脊液常规及细菌学检查结果